下列何种感染可用糖皮质激素治疗
A. 角膜溃疡
B. 真菌感染
C. 抗菌药不能控制的感染
D. 重症伤寒
E. 二重感染

正确答案：D。重症伤寒